维生素D缺乏手足抽搐症发生惊厥时，除给氧和保持呼吸道通畅外，应立即采取的措施是
A. 肌注维生素D₃
B. 静脉补充钙剂
C. 肌注硫酸镁
D. 静注或肌注地西泮
E. 静滴甘露醇

正确答案：D。静注或肌注地西泮

解析：维生素D缺乏时，血钙下降而甲状旁腺不能代偿性分泌增加，当血钙过低时可引起神经肌肉兴奋性增高，出现抽搐。维生素D缺乏手足抽搐症发生惊厥时，喉痉挛对患者的危险性最大，易发生窒息，所以此时的急救处理应为给氧和保持呼吸道通畅，且需静注或肌注地西泮来控制惊厥或喉痉挛（D对）。肌注维生素D₃（A错）和静脉补充钙剂（B错）都是维生素D佝偻病的治疗措施，不用于维生素D缺乏手足抽搐症发生惊厥的急救。肌注硫酸镁（C错）可作为抗惊厥药，常用于妊娠高血压，降低血压，治疗先兆子痫和子痫，也用于治疗早产。静滴甘露醇（E错）常用于治疗脑水肿。